男，6岁。严重营养不良，口腔卫生较差，软垢和牙石较多。龈乳头及龈缘坏死，牙龈边缘呈蚕食状缺损，表面有灰白色假膜，患处易出血。颌下淋巴结肿大。镜下可见病变表面有纤维素性渗出，结缔组织水肿，有大量中性粒细胞浸润，龈沟液涂片可见到大量的螺旋体和梭形杆菌。病理诊断为
A. 慢性龈炎
B. 龈增生
C. 急性坏死性溃疡性龈炎
D. 浆细胞龈炎
E. 剥脱性龈病损

正确答案：C。急性坏死性溃疡性龈炎

解析：本题考查急性坏死性溃疡性龈炎。急性坏死溃疡性龈炎（C对）好发于营养不良、口腔不洁的儿童，牙龈的龈缘及龈乳头坏死，牙龈边缘呈蚕蚀状破坏缺失，表面覆以灰白色假膜，镜下见病变表面有纤维素性渗出及组织变性、坏死形成的污秽假膜，龈沟液涂片可见大量的梭形杆菌及奋森螺旋体等微生物。慢性龈炎（AB错）好发于口腔不洁的儿童青少年和不刷牙的成人，一种表现为炎症水肿，龈缘红肿、光亮、松软、易出血，一种为增生性龈炎，在牙龈的龈沟壁处有炎症细胞浸润，在沟内上皮的下方可见中性粒细胞、淋巴细胞（主要为T淋巴细胞）。浆细胞龈炎（D错）以浆细胞密集浸润为特征。剥脱性龈病损（E错）是多种疾患在牙龈的表征，镜下剥脱性龈病损可分为疱型与苔藓型。疱型中，形成基底下疱，结缔组织内有明显的炎症，病变同良性黏膜类天疱疮；形成上皮内疱病变同天疱疮。苔藓型者，上皮萎缩、棘层变薄，基底细胞水肿、液化，基底层附近常见胶样小体，病变符合于疱性或萎缩性扁平苔藓。